《素问·至真要大论》属“湿”的病机为
A. 诸暴强直
B. 诸胀腹大
C. 诸病胕肿，疼酸惊骇
D. 诸病水液，澄澈清冷
E. 诸痉项强

正确答案：E。诸痉项强

解析：诸痉项强，皆属于湿（E对）。诸暴强直，皆属于风（A错）。诸胀腹大，皆属于热（B错）。诸病胕肿，疼酸惊骇，皆属于火（C错）。诸病水液，澄澈清冷，皆属于寒（D错）。